直肠指检可触及索状物，挤压式条索状物的肛旁端有脓性分泌物流出。最可能的诊断是
A. 肛瘘
B. 内痔
C. 外痔
D. 直肠癌
E. 直肠息肉

正确答案：A。肛瘘

解析：直肠指检可触及索状物，挤压式条索状物的肛旁端有脓性分泌物流出，考虑肛瘘（A对）。痔为暗红色圆形柔软的血管团，一般不易扪及，多柔软（BC错）。直肠癌在直肠指检时可扪到高低不平的肿块（D错）。直肠息肉为圆形、实质性、有蒂、可活动的肿块（E错）。